补中益气汤的主治证是
A. 表虚自汗证
B. 气阴两虚证
C. 心脾两虚证
D. 脾虚气陷证
E. 脾虚挟湿证

正确答案：D。脾虚气陷证

解析：补中益气汤的功用为补中益气，升阳举陷，主治1.脾胃气虚证2.气虚下陷证。3.气虚发热证。结合选项，脾虚气陷证是最合适选项（D对）。玉屏风散的主治证是表虚自汗证（A错）。新加黄龙汤的主治证是气阴两虚证（B错）。归脾汤的主治证是心脾两虚证（C错）。参苓白术散的主治证是脾虚挟湿证（E错）。